特殊管理的药品是指
A. 麻醉药品、放射性药品、毒性药品、抗肿瘤药品
B. 麻醉药品、放射性药品、毒性药品、生物制品
C. 生物制品、放射性药品、毒性药品、精神药品
D. 麻醉药品、放射性药品、毒性药品、精神药品
E. 放射性药品、毒性药品、精神药品、抗肿瘤药品

正确答案：D。麻醉药品、放射性药品、毒性药品、精神药品

解析：本题考查特殊管理药品。特殊管理药品是指《药品管理法》第35条规定的药品，即“国家对麻醉药品、精神药品、医疗用毒性药品、放射性药品（D对）实行特殊管理”。特殊管理药品的特殊性，在于这类药品虽然与普通药品一样具有特殊的药理、生理作用，如果管理或使用不当将严重危害患者及公众的生命健康乃至社会的利益。故抗肿瘤药品（AE错）和生物制品（BC错）均不属于特殊管理的药品。